太子参原植物所属的科是
A. 蓼科
B. 毛莨科
C. 豆科
D. 石竹科
E. 五加科

正确答案：D。石竹科

解析：本题考查的是太子参的来源。太子参原植物所属的科是石竹科（D对）。太子参：【来源】为石竹科植物孩儿参的干燥块根。来源于蓼科（A错）的药材有大黄、虎杖、何首乌、蓼大青叶等。来源于毛茛科（B错）的药材有威灵仙、川乌、附子、白芍、赤芍、升麻等。来源于豆科（C错）的药材有葛根、甘草、黄芪、鸡血藤、降香、合欢皮、番泻叶、槐花等。来源于五加科（E错）的药材有人参、红参、三七、通草等。